诊断慢性肺心病的主要依据是
A. 长期肺结核病
B. 长期慢性支气管炎
C. 肺动脉高压及右心室肥大
D. 肺动脉狭窄
E. 两下肢浮肿

正确答案：C。肺动脉高压及右心室肥大

解析：肺心病由慢性广泛性肺—胸疾病发展而来，呼吸及循环系统症状常混杂出现。有慢性广泛性肺、胸疾病患者，一旦发现有肺动脉高压、右心室肥大（C对）同时排除引起右心增大的其他疾病时，即可诊断为慢性肺心病。长期肺结核病（A错）及慢性支气管炎（B错）病史，不是诱发肺心病的原因。肺动脉狭窄（D错）、两下肢浮肿（E错）不是肺心病的主要表现。